药物治疗中医生应遵循的伦理要求是
A. 审方认真，调配迅速
B. 操作正规，称量准确
C. 对症下药，剂量安全
D. 忠于职守，严格管理
E. 关心患者，体贴入微

正确答案：C。对症下药，剂量安全

解析：药物治疗中医生应遵循的伦理要求：1)对症下药，剂量安全；2)合理配伍，细致观察；3)节约费用，公正分配。ABD项为药学技术人员应遵循的伦理要求，E项为手术中的伦理要求。掌握“临床治疗和临床急救的伦理”知识点。